雌二醇临床用于
A. 偏头痛
B. 催生
C. 绝经期综合征
D. 功能性子宫出血
E. 晚期乳腺癌

正确答案：C、D。绝经期综合征；功能性子宫出血

解析：本题考查雌二醇的临床作用。雌二醇临床用于绝经期综合征（C对）、功能性子宫出血（D对）。催生（B错）临床使用催产素。晚期乳腺癌（E错）临床使用雄激素，如丙酸睾酮。偏头痛（A错）临床常用NSAIDs如对乙酰氨基酚。